妊娠期妇女不宜选用的抗菌药物类别是
A. 青霉素
B. 头孢菌素类
C. 碳青霉烯类
D. 氟喹诺酮类
E. β-内酰胺霉抑制剂与β内酰胺霉类抗生素的复方制剂

正确答案：D。氟喹诺酮类

解析：本题考查氟喹诺酮类药物的禁忌症。喹诺酮类（D对）在乳汁也有分布，妊娠及哺乳期妇女应避免服用。妊娠期妇女确有必要时可服用青霉素（A错）。头孢菌素（B错）可由乳汁分泌，哺乳期妇女须权衡利弊后决定。碳青霉烯类（C错）仅在治疗的有益性超过危险性时使用。妊娠期妇女应慎用β-内酰胺酶抑制剂与β-内酰胺酶类抗生素的复方制剂（E错）。